泽泻说法正确的是
A. 药用部位是块茎
B. 含蒽醌类化合物
C. 二者均是
D. 二者均不是

正确答案：A。药用部位是块茎

解析：本题考查的是泽泻的来源与化学成分。泽泻的药用部位是块茎（A对）。泽泻：【来源】为泽泻科植物泽泻的干燥块茎。含蒽醌类化合物（B错）的常用中药有大黄、虎杖、何首乌、芦荟、决明子等。